两样本均数比较的t检验，差别有统计学意义时，P越小，说明
A. 两总体均数的差别不大
B. 两总体均数的差别越大
C. 越有理由认为两总体均数的差别很大
D. 越有理由认为两样本均数不同
E. 越有理由认为两总体均数不同

正确答案：E。越有理由认为两总体均数不同

解析：两样本均数比较的t检验，差别有统计学意义时，P越小越有理由拒绝原假设，认为两总体均数不同（E对）。配对t检验反映的是样本均数所代表的未知总体，而非样本均数（D错）；P＜α只能说明差异具有统计学意义，并不代表实际差异的大小（ABC错）。